患儿，4岁。2天来发热恶风，咳嗽频频，气急鼻煽，涕泪俱无，喉中痰鸣，舌红苔黄，脉浮数而滑。其证候是
A. 痰热咳嗽
B. 风热咳嗽
C. 痰热闭肺
D. 风热闭肺
E. 热性哮喘

正确答案：D。风热闭肺

解析：患儿发热恶风，咳嗽频频，气急鼻煽，涕泪俱无，喉中痰鸣，当属肺炎喘嗽，其以发热、咳嗽、痰壅、气急、鼻煽为主要症状，小儿外感风热，侵犯肺卫，闭郁不宣，炼液成痰，阻于气道，从而出现发热恶风，咳嗽频频，气急鼻煽，喉中痰鸣，舌红苔黄，脉浮数而滑为风热闭肺之象（D对）。痰热咳嗽应见咳痰多，色黄黏稠，难以咯出，舌红苔黄腻，脉滑数（A错）。风热咳嗽应见咳嗽不爽，痰黄黏稠，发热恶风，舌红苔薄黄，脉浮数（B错）。痰热闭肺应见发热烦躁，咳嗽喘促，呼吸困难，气急鼻煽，喉间痰鸣，口唇紫绀，面赤口渴，舌红苔黄，脉弦滑，无恶风、恶寒等表证（C错）。热性哮喘应见咳嗽喘急，声高息涌，咳痰稠黄，身热咽红，舌红苔黄（E错）。